腹股沟疝处理原则正确的是
A. 2岁以下，疝环直径小于1.5cm的婴幼儿可暂不手术
B. 如果伴有引起腹内压增高的疾病，必须处理后再择期手术
C. 无张力疝修补术强调必须高位结扎疝囊
D. 加强腹股沟管前壁是最常用的方法
E. 嵌顿时间在6小时内的疝应首先试行手法复位

正确答案：B。如果伴有引起腹内压增高的疾病，必须处理后再择期手术

解析：腹股沟疝如不及时处理，将严重影响患者工作和生活，甚至危及患者的生命。因此，腹股沟疝一般均应尽早施行手术治疗。1岁以下的婴幼儿因腹肌可随躯体生长逐渐强壮，疝有自行消失的可能，所以可暂不手术（A错）；年老体弱或伴有其他严重疾病而禁忌手术者也可采用非手术治疗。如果伴有引起腹内压增高的疾病（如慢性咳嗽、排尿困难、严重便秘等），必须处理后再择期手术（B对）。无张力疝修补术是将疝还纳后，用人工高分子材料网片进行修补，不需要作疝囊高位结扎（C错）；疝修补术是腹股沟疝最常用、最有效的治疗方法（D错）。嵌顿时间在3～4小时以内，局部压痛不明显，无明显的腹膜刺激征者及年老体弱或伴有其他较严重疾病而估计肠袢尚未绞窄坏死者，可先试行手法复位（E错）。